患者，女，32岁，已婚未孕。3个月前出现腹泻，多为稀糊状，间断为黏液及脓血便，每日8～12次，有里急后重感，结肠镜检査诊断溃疡性结肠炎（全结肠型），医师处方美沙拉嗪缓释片和美沙拉嗪灌肠剂。关于美沙拉嗪治疗作用的说法，正确的是
A. 美沙拉嗪主要通过在肠道内发挥局部作用而产生治疗作用
B. 美沙拉嗪缓释片仅作用于近端结肠
C. 美沙拉嗪为柳氮磺吡啶的前体药物，水解后起效
D. 美沙拉嗪灌肠剂仅能作用于直肠局部病变
E. 美沙拉嗪通过结构中的磺胺吡啶所具有的抗菌活性产生治疗作用

正确答案：A。美沙拉嗪主要通过在肠道内发挥局部作用而产生治疗作用

解析：本题考查美沙拉嗪。美沙拉嗪通过在肠道内发挥局部黏膜抗炎作用起效（A对），而不是全身作用。美沙拉嗪的控释制剂为pH依赖性药物，释放部位为回肠末端和结肠。美沙拉嗪缓释片可作用于远段空肠、回肠和结肠的病变（B错）。美沙拉嗪灌肠剂用于病变在直肠和乙状结肠的患者（D错）。